全口义齿初戴时发现正中（牙合）正常，前伸（牙合）前牙早接触应调磨
A. 上切牙切缘舌斜面
B. 上切牙切缘唇斜面
C. 上切牙舌窝
D. 下切牙切缘
E. 下切牙舌斜面

正确答案：A。上切牙切缘舌斜面

解析：本题考查前伸（牙合）（牙合）干扰的选磨。全口义齿初戴时发现正中（牙合）正常，前伸（牙合）前牙早接触时应优先调磨下前牙唇斜面，在不影响美观的前提下，上前牙舌侧面也可以调磨（A对）。若调磨上切牙切缘唇斜面（B错）则对美观影响较大。而调磨上切牙舌窝（C错）则不能起到调节早接触的作用。下切牙的切缘高度不应破坏，故不应调磨下切牙切缘（D错）。而调磨下切牙舌斜面（E错）也不能起到调节早接触的作用。